初产妇，孕37周，8小时前突然出现阴道流液，如小便样，6小时前开始出现规律宫缩，因胎手脱出于阴道口1小时就诊。查体：产妇烦躁不安，腹痛拒按，脉搏110次/分，呼吸28次/分，胎心160次/分，导尿时见血尿。诊断首先考虑
A. 胎膜早破
B. 子宫破裂
C. 先兆子宫破裂
D. 前置胎盘
E. 胎盘早剥

正确答案：C。先兆子宫破裂

解析：该孕妇，孕37周，8小时前突然出现阴道流液，如尿样，因胎手脱出于阴道口1小时就诊（胎位异常者易发生胎膜早破，胎膜早破的患者突感有较多液体从阴道流出，胎位异常为子宫破裂的病因之一），烦躁不安，腹痛拒按，阴道流血及血尿（先兆子宫破裂会有腹痛，病理缩复环，血尿等表现），胎膜早破（P133）（A错）虽可表现为孕妇感觉阴道内有尿样液体流出，但是无产妇烦躁不安，腹痛拒按等症状，故诊断首先考虑为先兆子宫破裂（C对）。子宫破裂（P218）（B错）分为不完全性子宫破裂和完全性子宫破裂，不完全性子宫破裂多见于子宫下段剖宫产切口瘢痕破裂，常缺乏先兆子宫破裂症状，仅在不全破裂处有压痛，体征不明显；完全性子宫破裂继先兆子宫破裂症状后，产妇突感下腹一阵撕裂样剧痛，子宫收缩骤然停止，后伴有低血压休克症状，胎心胎动消失。前置胎盘（P127）（D错）典型症状为妊娠晚期或临产时，发生无诱因、无痛性反复阴道流血。胎盘早剥（P131）（E错）多见于有重度妊娠高血压综合征等高危因素的患者，表现为腹痛伴或不伴阴道流血，常伴休克症状。